手术后猝死最常见的病因是
A. 气胸
B. ARDS
C. 急性左心衰
D. 肺栓塞
E. 重症肺炎

正确答案：D。肺栓塞

解析：手术后猝死是患者手术后发生的突然性的死亡。手术后猝死最常见的病因是肺栓塞（D对），其包括脂肪栓塞和血栓性栓塞，血栓性肺动脉栓塞的后果极为严重，一旦发生，常导致猝死。气胸（A错）时胸腔内气体使肺组织压缩出现呼吸困难等症状，病情程度由肺萎缩程度而定；ARDS（急性呼吸窘迫综合征）（B错）指各种因素导致的急性弥漫性肺损伤和进而发展的急性呼吸衰竭；以上两种疾病与急性左心衰（C错）和重症肺炎（E错）导致死亡时都有病情进展恶化过程，一般不会导致突然性死亡。